小儿抗风湿热治疗，早期使用糖皮质激素的指征
A. 舞蹈病
B. 多关节炎
C. 环形红斑
D. 皮下小结
E. 心脏炎

正确答案：E。心脏炎

解析：小儿风湿热的治疗原则为早期诊断、合理治疗、预防复发，检测药物副作用，治疗目标是清楚链球菌感染，去除发病诱因，控制临床症状，迅速缓解心脏炎、舞蹈病及风湿热症状，处理各种并发症，提高患者身体素质和生活质量，延长寿命。抗风湿治疗常用药物有阿司匹林及糖皮质激素，药物的选择根据临床表现决定，阿司匹林用于表现为关节炎和轻型心脏炎患者，糖皮质激素作用较强，心脏炎（E对）时宜早期应用糖皮质激素，心脏炎伴有心力衰竭首选泼尼松。